小儿风寒咳嗽主方是
A. 桑菊饮加减
B. 清金化痰汤加减
C. 沙参麦冬汤加减
D. 金沸草散加减
E. 二陈汤加减

正确答案：D。金沸草散加减

解析：小儿风寒咳嗽主要是因风寒犯肺，腠理闭塞，肺气不能宣畅而致，治以疏风散寒，宣肺止咳，方药为金沸草散加减（D对）。桑菊饮（A错）其功用为疏风清热，宣肺止咳，适用于风热咳嗽。清金化痰汤（B错）其功用为清肺化痰止咳，适用于痰热咳嗽。沙参麦冬汤（C错）其功用为养阴润肺，适用于阴虚咳嗽。二陈汤（E错）其功用为燥湿化痰，理气和中，与三拗汤合用，具有健脾燥湿，化痰止咳的功效，适用于痰湿咳嗽。